最可能为结核性腹膜炎腹水的是
A. 腹水比重＜1.016，蛋白=20g/L
B. 腹水比重＞1.018，李凡他（Rivalta）试验阳性
C. 乳糜样腹水
D. 腹水细胞总数＞1000×10⁶/L，分类以中性粒细胞为主
E. 腹水细胞总数为1000×10⁶/L，分类以间皮细胞为主

正确答案：B。腹水比重＞1.018，李凡他（Rivalta）试验阳性

解析：结核性腹膜炎腹水为渗出液，李凡他（Rivalta）试验（P118）阳性，比重一般超过1.018（B对），蛋白质定性试验阳性，定量在30g/L以上（A错）。腹水多为草黄色或淡血性，偶为乳糜性（C错）。腹水中白细胞计数超过500×10⁶/L，分类以淋巴细胞或单核细胞为主（DE错）。